药材的根是圆柱形的是
A. 何首乌
B. 甘草
C. 麦冬
D. 黄芪
E. 牛膝

正确答案：B、D、E。甘草；黄芪；牛膝

解析：本题考查的是根及根茎类中药的形状。药材的根是圆柱形的是甘草（B对）、黄芪（D对）、牛膝（E对）。根的形状通常为圆柱形、长圆锥形、圆锥形或纺锤形等。双子叶植物的根一般为直根系，主根发达，侧根较细。主根常为圆柱形，如甘草、黄芪、牛膝等；或呈圆锥形，如白芷、黄芩、桔梗等；有的呈纺锤形，如地黄、何首乌（A错）等；少数为须根系，多数细长的须根集生于根茎上，如细辛、威灵仙、龙胆等。单子叶植物的根一般为须根系，有的须根先端膨大成纺锤形块根，如百部、郁金、麦冬（C错）等。